初产妇，26岁。分娩过程中，宫口开全3小时10分钟，先露S+2，胎位LOT，宫缩强度由强转为中，持续40分钟，宫缩间歇时间由2.5分钟延长至4～5分钟，诊断为第二产程延长，造成这种情况最常见的原因是下列哪一项
A. 宫缩乏力
B. 产妇衰竭
C. 中骨盆平面狭窄
D. 骨盆出口狭窄
E. 胎儿过大

正确答案：C。中骨盆平面狭窄

解析：青年初产妇，宫口开全，S＋2（已达坐骨棘平面以下2cm），LOT（出现左枕横位），宫缩的强度出现由强转中，宫缩间歇时间延长至4～5分钟（正常为1～2分钟），第二产程延长（超过3小时），考虑为中骨盆平面狭窄（C对）引起的内旋转受阻，胎头双顶径被阻于中骨盆狭窄部位之上，出现持续性枕横位，同时出现继发性宫缩乏力，导致第二产程延长。原发性宫缩乏力（A错）从产程开始即出现，本题为第二产程出现子宫收缩力量减弱，是中骨盆狭窄引起的继发性宫缩乏力；该产妇的临床表现无各生命体征不稳定的情况，故排除产妇衰竭（B错）；胎显露S＋2，尚未到达骨盆出口平面，无法判断骨盆出口狭窄（D错）。胎儿过大会出现胎头衔接受阻（E错）。